某山区于20世纪60年代，陆续出现不少骨骼变形以致丧失劳动能力的人，后经上级派员进行调查，发现这些患者除肢体骨骼变形外，还有明显的黑褐色斑牙。当时初步诊断为氟骨症，但水及土壤氟含量不高。在这种情况下，最应进一步检测的项目是
A. 进行卫生调查
B. 村民吸烟情况调查
C. 核查饮水中氟含量
D. 检测燃料中氟含量
E. 检测蔬菜中氟含量

正确答案：D。检测燃料中氟含量

解析：本题考查诊断氟骨症应检测的项目。氟骨症是一种由氟离子引起的疾病，其特征是骨骼变形和黑褐色斑牙。因此，要找出氟骨症的起因，最重要的是检测氟离子的来源。在这种情况下，水及土壤氟含量不高，因此应该进一步检测燃料中氟含量（D对ABCE错），以确定氟离子的来源。